下列哪项不会在应激中发生？
A. 心率加快
B. 肾动脉扩张
C. 心肌收缩力增强
D. 心输出量增加
E. 皮肤血管收缩

正确答案：B。肾动脉扩张

解析：心率加快（A对）、肾动脉收缩（B错，为本题正确答案）、心肌收缩力增强（C对）、心输出量增加（D对）和皮肤血管收缩（E对）均会在应激中发生。